治疗风热郁闭，咽喉肿痛，大便秘结者，应首选
A. 薄荷
B. 蝉蜕
C. 菊花
D. 蔓荆子
E. 牛蒡子

正确答案：E。牛蒡子

解析：薄荷具有疏散风热，清利头目，利咽透疹，疏肝行气的功效，能用于治疗风热郁闭，咽喉肿痛（A错）。蝉蜕具有疏散风热，利咽开音，透疹，明目退翳，息风止痉的功效，能治疗风热郁闭，咽喉肿痛（B错）。菊花具有疏散风热，平抑肝阳，清肝明目，清热解毒的功效，能治疗风热郁闭（C错）。蔓荆子具有疏散风热，清利头目的功效，能治疗风热郁闭（D错）。牛蒡子具有疏散风热，宣肺祛痰，利咽透疹，解毒消肿的功效，同时牛蒡子性寒，能滑肠通便，治疗大便秘结，故牛蒡子能治疗风热郁闭，咽喉肿痛，大便秘结。牛蒡子性寒滑肠的功效为为常考点，需牢记（E对）。